男，50岁。半小时前自高处坠落，上下肢完全不能活动，双侧腹股沟水平以下感觉障碍，大小便失禁。CT显示椎体爆裂骨折，椎管内可见骨折块。目前应选择的治疗方法是
A. 药物治疗
B. 石膏固定
C. 平卧硬板床
D. 手术治疗
E. 牵引治疗

正确答案：D。手术治疗

解析：50岁男性患者，半小时前自高处坠落（外伤史），上下肢完全不能活动，双侧腹股沟水平以下感觉障碍，大小便失禁（提示脊髓损伤）。CT显示椎体爆裂骨折，椎管内可见骨折块（突入的骨折块损伤脊髓），结合患者病史、临床表现及检查，该患者最可能的诊断为颈椎爆裂性骨折伴脊髓损伤，考虑到患者椎管内有骨块进入损伤脊髓，已有神经症状，应选择手术治疗（D对）。药物治疗（A错）不是骨折的主要治疗措施，可作为辅助及对症支持治疗。石膏固定（B错）用于脊柱后凸成角＜30%的压缩骨折、屈曲分离性骨折和单纯椎弓峡部骨折。平卧硬板床（C错）及早期背伸锻炼均为轻度压缩骨折患者非手术治疗措施。牵引治疗（E错）用于颈椎骨折的治疗。